2015年12月3日9点，某市级人民政府接到县级人民政府发生的重大食物中毒事件的报告，依据《突发公共卫生事件的应急条例》的规定，该政府向省级人民政府报告的最迟期限是
A. 2015年12月3日10点
B. 2015年12月3日11点
C. 2015年12月3日12点
D. 2015年12月3日13点
E. 2015年12月3日14点

正确答案：B。2015年12月3日11点

解析：《突发公共卫生事件的应急条例》第二十条规定了市级人民政府应当在接到报告后2小时内向省、自治区、直辖市人民政府报告，所以最迟应当是11点。故本题选B。掌握“突发公共卫生事件报告与法律责任”知识点。